常有3个以上的胞质突起，在功能上属抗原呈递细胞的是
A. 成纤维细胞
B. 成牙本质细胞
C. 树突状细胞
D. T淋巴细胞
E. 巨噬细胞和未分化的间充质细胞

正确答案：C。树突状细胞

解析：树突状细胞：主要分布在牙髓中央区的血管周围和牙髓的外周区如成牙本质细胞周围。此细胞常有3个以上的胞质突起，在功能上属抗原呈递细胞，是牙髓免疫防御系统中重要的组成部分。掌握“牙髓”知识点。